癫痫持续状态首选的治疗方案是
A. 口服丙戊酸钠200mg
B. 静脉注射地西泮10mg
C. 静脉注射丙戊酸钠200mg
D. 口服地西泮10mg
E. 肌内注射地西泮10mg

正确答案：B。静脉注射地西泮10mg

解析：本题考查抗癫痫药。静脉注射地西泮（B对DE错）为治疗癫痫持续状态时的首选。丙戊酸钠（AC错）是治疗癫痫失神发作、原发性全面性发作、强直阵挛发作、失张力发作、部分性发作的首选。